目前临床使用最广泛的一种橡胶类印模材为
A. 琼脂类
B. 藻酸盐类
C. 聚醚橡胶类
D. A型硅橡胶
E. 缩合型硅橡胶

正确答案：D。A型硅橡胶

解析：加成型硅橡胶，又称A型硅橡胶，是目前临床使用最广泛的一种橡胶类印模材。优点：表面清晰度及尺寸稳定性优异。掌握“暂时冠及印模与模型”知识点。